右侧内囊出血后出现
A. 右侧肢体痉挛性瘫痪
B. 右侧肢体弛缓性瘫痪
C. 左侧肢体痉挛性瘫痪
D. 左侧肢体弛缓性瘫痪
E. 右侧听觉丧失

正确答案：C。左侧肢体痉挛性瘫痪

解析：皮质脊髓束下行经内囊后肢的前部等部分至延髓锥体，在锥体下端，大部分的纤维交叉至对侧，形成锥体交叉。交叉后的纤维主要支配四肢肌，而其中小部分未交叉的纤维支配躯干肌和上肢近端肌的运动。皮质脊髓前束中有部分纤维始终不交叉，主要支配躯干肌。所以，躯干肌是受两侧大脑皮质支配，而上、下肢肌只受对侧大脑皮质支配，故一侧皮质脊髓束在锥体交叉前受损，主要引起对侧肢体瘫痪。而脑神经运动核以上的锥体系损伤，使得肌张力增高，称痉挛性瘫痪。系统解剖书第九版“图19-7 锥体系中的皮质脊髓束与皮质核束”（P389）可见，内囊位于锥体交叉前，右侧内囊出血主要引起左侧肢体（即对侧）痉挛性瘫痪（C对）。